一患者下颌左5678右678缺失，左下4不松动、无龋，牙槽嵴丰满。铸造支架式义齿左下4右下5远中（牙合）支托、三臂卡固位体，舌杆大连接体。义齿戴用1周后，主诉基托压痛、基牙咬合痛。口腔内检查发现：舌系带根部小溃疡，左侧下颌隆凸处黏膜红肿，左下4叩痛（+），义齿各部分密合，咬合不高。基牙疼痛的原因是
A. 牙周病
B. 根尖周炎
C. 受力过大
D. 牙本质过敏
E. 咬合干扰

正确答案：C。受力过大

解析：本题考查义齿戴入后可能出现的问题。患者下颌左5678右678缺失仅用左下4右下5作为基牙，容易出现基牙受力过大，黏膜压痛的情况。可摘局部义齿戴用后在咬合不高的情况下出现基托压痛、基牙咬合痛，则可知患者基牙疼痛的原因是基牙受力过大（C对）。牙周病及根尖周炎时，患牙会有松动现象，经检查，患者左下4不松动、无龋，可知基牙健康，疼痛的原因不是牙周病（A错）及根尖周炎（B错）。牙本质过敏（D错）不会出现基牙咬合痛。该患者的义齿各部分密合，咬合不高，不存在早接触等咬合干扰现象，所以咬合干扰（E错）不是基牙疼痛的原因。